下列不属于健康危险行为特征的是
A. 后天生活习惯
B. 长期稳定的行为
C. 偶然性行为
D. 有明显的健康危害
E. 偏离行为

正确答案：C。偶然性行为